关于脊神经，正确的描述为
A. 是运动性神经
B. 是感觉性神经
C. 是混合性神经
D. 神经根的长度,由上而下逐渐缩短
E. 在胸部以下的脊神经根呈水平方向出相8应的椎间孔

正确答案：C。是混合性神经

解析：脊髓由躯体神经纤维和内脏神经纤维合成，是混合性神经（C对）。颈神经根最短，行程近于水平，胸神经根较长，斜向外下走行，腰神经根最长，几近垂直下行，在无脊髓的椎管内形成了马尾（D错）。，所有胸神经和腰神经都经同序数椎骨下方的椎间孔穿出椎管（E错）。